精神运动性发作的首选药是
A. 丙戊酸钠
B. 苯妥英钠
C. 乙琥胺
D. 苯巴比妥
E. 卡马西平

正确答案：E。卡马西平

解析：本题考查抗癫痫药。精神运动性发作的首选药是卡马西平（E对）。卡马西平是治疗精神运动性发作的首选药物，治疗三叉神经痛和舌咽神经痛疗效优于苯妥英钠，对躁狂症疗效也比锂盐好而副作用少。丙戊酸钠（A错）为一广谱抗癫痫药，临床用于各型癫。苯妥英钠（B错）对癫痫大发作、单纯部分性发作和对精神运动性发作疗效较好，但对小发作无效或甚至加重。乙琥胺（C错）临床为治疗小发作的首选药。苯巴比妥（D错）是防止大发作（尤其儿童）的首选药。